希波克拉底宣言的内容不包括下列哪一点
A. 为病人保密
B. 强调医生的品德修养
C. 尊重同道
D. 要有好的仪表和作风
E. 为病人谋利益

正确答案：D。要有好的仪表和作风

解析：《希波克拉底誓言》是历史上倡导医德最早、最系统、最重要的文献，主要包括以下内容：①强调为病家保密（A对）；②强调医生的品德修养（B对）；③尊重同道（C对）和医学传承；④为病人谋利益（E对），不包括要有好的仪表和作风（D错，为本题正确答案）。